堪称为发表散风通用药的是
A. 生姜
B. 紫苏
C. 桂枝
D. 荆芥
E. 细辛

正确答案：D。荆芥